急性乏氧性缺氧时机体的主要代偿方式是
A. 心率减慢
B. 心肌收缩性减弱
C. 肺通气量和心输出量增加
D. 脑血流量减少
E. 腹腔内脏血流量增加

正确答案：C。肺通气量和心输出量增加

解析：急性乏氧性缺氧时，PaO₂降低刺激颈动脉和主动脉化学感受器，反射性兴奋呼吸中枢，使呼吸加深加快，肺泡通气量增加。同时，交感神经兴奋使心率加快（A错），心肌收缩力增强（B错），以及因呼吸运动增强而致的心回血量增加及心输出量增加（C对）。另外，缺氧时全身各器官的血流分布发生改变，心和脑的血流量增多（D错），而皮肤、内脏（E错）、骨骼肌和肾的组织血流量减少。